小儿腹泻的好发年龄是
A. 2周岁以下
B. 2周岁～3周岁
C. 4周岁～6周岁
D. 8周岁～9周岁
E. 10周岁以上

正确答案：A。2周岁以下

解析：该题考查小儿腹泻的好发年龄。小儿腹泻的好发年龄是2岁以下（A对）因为婴幼儿脾常不足，易于感受外邪、伤于乳食或脾肾气阳亏虚，均可导致脾病湿盛而发生泄泻。